男性，49岁。刺激性咳嗽5个月，视物不清10天，胸片示左肺上叶尖段边缘直径8cm不规则块状阴影，此病变造成的颈交感神经综合征不包括
A. 面部无汗
B. 瞳孔缩小
C. 眼球内陷
D. 声音嘶哑
E. 上睑下垂

正确答案：D。声音嘶哑

解析：本例患者中老年男性，刺激性咳嗽5个月，视物不清10天，胸片示左肺上叶尖段边缘直径8cm不规则块状阴影。根据病史考虑其为肺尖癌导致的颈交感神经麻痹综合征。颈交感神经麻痹综合征即Horner综合征，是以患侧眼球内陷（C对）、瞳孔缩小（B对）、上睑下垂（E对）、血管扩张及面颈部无汗（A对）为特征的一组交感神经麻痹症候群。在交感神经径路上发生的炎症、肿瘤、创伤、手术等因素均可引起。声音嘶哑（D错，为本题正确答案）见于喉返神经麻痹。